抗菌活性强，可产生前庭反应的药物是
A. 氯霉素
B. 多西环素
C. 土霉素
D. 四环素
E. 米诺环素

正确答案：E。米诺环素